能用碘化铋钾检识的生物碱有
A. 乌头碱
B. 吗啡
C. 次乌头碱
D. 小檗碱
E. 莨菪碱

正确答案：A、C、D、E。乌头碱；次乌头碱；小檗碱；莨菪碱